补气缓急宜炙用，泻火解毒宜生用的药是
A. 大枣
B. 黄芪
C. 甘草
D. 白扁豆
E. 太子参

正确答案：C。甘草

解析：本题考查的是甘草的性能特点。补气缓急宜炙用，泻火解毒宜生用的药是甘草（C对）。甘草：【性能特点】本品甘补润缓，生平偏凉，炙平偏温，主入脾、肺经，兼入胃、心经。既益气补中，又缓急止痛、缓和药性，还祛痰止咳、解毒。蜜炙补气缓急力强；生用能泻火解毒。大枣（A错）：【性能特点】本品甘温补缓，入脾、胃经。既补中益气，又养血安神，为气血双补之品，善治脾虚和血虚诸证。与峻烈之品同用，能调和药性、健脾护胃。黄芪（B错）：【性能特点】本品甘温补升，甘淡渗利；生用微温，蜜炙性温，入脾、肺经，主以扶正气，兼能除水邪。既善补中气、升举清阳，又善补肺气、益卫固表，治脾肺气虚、中气下陷、气不摄血、自汗盗汗等，还能托疮毒、利水消肿，治气血不足之疮痈不溃或久溃不敛，以及气虚水肿、小便不利。此外，通过补气又能生血、摄血、生津、行滞，治血虚萎黄、气不摄血之崩漏便血、气津两伤之消渴、气虚血滞之痹痛麻木和半身不遂等。白扁豆（D错）：【性能特点】本品甘补解毒，微温化湿，入脾、胃经。既能健脾化湿，治脾虚夹湿证；又能化湿和中而消暑，治暑湿吐泻；还能解酒毒，治食物中毒等。太子参（E错）：【性能特点】本品平而偏凉，甘补微苦能泄，入脾、肺经，补中略兼清泄。功似人参，而药力甚弱。能补气生津，多用于气津两伤之轻症，或兼热者更宜。